关于高血压的流行病学调查，下列哪项因素未确定与发病有关
A. 年龄
B. 体重
C. 钠盐
D. 吸烟
E. 饮酒

正确答案：E。饮酒

解析：高血压是遗传因素与环境因素长期相互作用而形成的慢性疾病，影响高血压发病的危险因素可分为不可改变的危险因素和可改变的危险因素：不可改变的危险因素主要有年龄（A对）、性别、遗传因素，可改变的危险因素主要有高钠低钾（C对）、超重和肥胖（B对）、吸烟（D对）、精神紧张。过量饮酒（E错，为本题正确答案）尚未确定与高血压发病有关。